不属于反映大骨节病胶原代谢紊乱的指标的是
A. 尿羟赖氨酸
B. 尿微球蛋白
C. 硫酸软骨素含量
D. 硫酸软骨素酸化程度
E. 尿羟脯氨酸

正确答案：B。尿微球蛋白

解析：本题考查大骨节病胶原代谢紊乱的指标。大骨节病的胶原代谢指标主要为：硫酸软骨素（C对）硫酸化程度（D对）；尿中羟脯氨酸（E对）、羟赖氨酸（A对）排出量。尿微球蛋白（B错，为本题正确答案）不属于大骨节病胶原代谢紊乱的指标。